患者，女，38岁。阵发性劳力性呼吸困难3年，咳痰带血丝1个月。超声心动图检查证实为二尖瓣狭窄。下列哪项体征具有诊断意义
A. 心尖区3/6级收缩期杂音，向左腋下传导
B. 胸骨右缘第4肋间收缩期杂音
C. 胸骨左缘第2肋间GrahamSteell杂音
D. 心尖区隆隆样舒张中、晚期杂音
E. 心尖区隆隆样舒张早期杂音

正确答案：D。心尖区隆隆样舒张中、晚期杂音

解析：二尖瓣狭窄痰中带血或血痰，常伴夜间阵发性呼吸困难，特征性杂音为心尖区舒张中晚期低调的隆隆样杂音，呈递增型，局限（D对）。器质性心脏病变心脏杂音至少达3/6级以上，且二尖瓣狭窄是心尖区听诊为舒张期杂音，杂音局限，不会向左腋下传导（A错）。二尖瓣狭窄的杂音为心尖区舒张中晚期低调的隆隆样杂音（B错）。当二狭合并严重的肺动脉高压时，由于肺动脉及其瓣环的扩张，导致相对性肺动脉瓣关闭不全，因而在胸骨左缘第2肋间可闻及递减型高调叹气样舒张早期杂音，即Graham-Steell杂音（C错）。二狭的杂音出现在舒张中晚期（E错）。